某初中学生，学习压力增加，一次体检时其血压值处于同性别同年龄组的P₉₇。医生的诊断是
A. 高血压
B. 高血压高危
C. 高血压待查
D. 正常
E. 低血压

正确答案：C。高血压待查